小儿指纹鲜红，其临床意义是
A. 外感表证，寒证
B. 里热证
C. 疼痛惊风
D. 脾虚，疳积
E. 血络郁闭

正确答案：A。外感表证，寒证

解析：小儿指纹鲜红主外感表证，寒证（A对）因邪正相争，气血趋向于表，指纹浮显，故纹色偏红。小儿里热证则指纹紫红（B错）。疼痛、惊风的指纹为青色（C错）。脾虚，疳积则指纹淡白（D错）。血络郁闭，病属重危，指纹紫黑（E错）。